地机穴位于
A. 胫骨内侧面后缘，内踝尖上5寸
B. 胫骨内侧髁下方凹陷处
C. 胫骨内侧面中央，内踝尖上5寸
D. 胫骨内侧面中央，内踝尖上7寸
E. 内踝尖与阴陵泉穴的连线上，阴陵泉下3寸

正确答案：E。内踝尖与阴陵泉穴的连线上，阴陵泉下3寸

解析：胫骨内侧面后缘，内踝尖上5寸无经穴（A错）。阴陵泉为足太阴脾经的合穴，位于胫骨内侧髁下方凹陷处（B错）。胫骨内侧面中央，内踝尖上5寸无经穴（C错）。胫骨内侧面中央，内踝尖上7寸无经穴（D错）。地机为足太阴脾经的郄穴，位于内踝尖与阴陵泉穴的连线上，阴陵泉下3寸（E对）。